津液不足的常见临床表现有
A. 舌光红无苔
B. 尿少便干
C. 两目视物昏花
D. 自汗乏力
E. 毛发肌肤枯槁

正确答案：A、B、E。舌光红无苔；尿少便干；毛发肌肤枯槁

解析：本题考查的是津液不足的临床表现。津液不足的常见临床表现有舌光红无苔（A对）、尿少便干（B对）与毛发肌肤枯槁（E对）。津液不足，是指津液在数量上的亏少，进而导致内则脏腑，外而孔窍、皮毛，失其濡润滋养作用，因之产生一系列干燥失润的病机变化。多由燥热之邪或五志之火，或发热、多汗、吐泻、多尿、失血，或过用误用辛燥之剂等引起津液耗伤所致。常见口、鼻、皮肤干燥，大吐、大泻、多尿时所出现的目陷、螺瘪，甚则转筋等；热病后期或久病伤阴，所见到的舌光红无苔或少苔、唇舌干燥而不引饮、形瘦肉脱、肌肤毛发枯槁，甚则肌肉、手足震颤蠕动等临床表现。燥邪最易耗伤人体的津液，造成阴津亏虚的病变，常见口鼻干燥、咽干口渴、皮肤干涩，甚则皲裂、毛发不荣、小便短少、大便干结等。两目视物昏花（C错）为血虚的临床表现。血虚，是指血液不足或血的濡养功能减退的病机变化。失血过多，新血来不及生成，或脾胃虚弱，饮食营养不足，化生血液的功能减弱或化源不足，而致血液化生障碍，或因久病不愈、慢性消耗等因素而致营血暗耗等，均可导致血虚。全身各脏腑、经络等组织器官，都依赖于血的濡养。在血虚时，就会出现全身或局部的失荣失养，功能活动逐渐衰退等虚弱的证候。例如，面色不华，唇舌爪甲色淡无华，头目眩晕，心悸怔忡，神疲乏力，形体瘦怯，或手足麻木，关节屈伸不利，或两目干涩，视物昏花等。血不足在女子最为多见，多与月经、胎孕、分娩、哺乳等密切相关，可引发月经量少，或经闭，或不孕，或乳少，或产子多羸弱。自汗乏力（D错）多因气虚卫阳不固所导致。自汗，指经常汗出不止，活动后加重的临床表现。多因气虚卫阳不固所导致，故常伴有神疲、乏力、气短、畏寒等阳气虚损的症状。